原发性和继发性肾上腺皮质功能减退鉴别诊断中最具意义的临床表现应为
A. 低血糖
B. 低血压
C. 食欲明显减退
D. 极度乏力
E. 皮肤色素沉着

正确答案：E。皮肤色素沉着